含有具光敏作用的呋喃香豆素类化合物的中药是
A. 莪术
B. 补骨脂
C. 牛蒡子
D. 斑蝥
E. 黄连

正确答案：B。补骨脂

解析：本题考查的是香豆素的理化性质。含有具光敏作用的呋喃香豆素类化合物的中药是补骨脂（B对）。呋喃香豆素的光化学毒性：许多香豆素具有光敏作用。呋喃香豆素外涂或内服后经日光照射可引起皮肤色素沉着。在所有的呋喃香豆素类化合物中，补骨脂素和异补骨脂素是中药补骨脂主要的有效成分。莪术（A错）含挥发油1.0%～2.5%。《中国药典》规定原药材含挥发油不得少于1.5（ml/g），饮片含挥发油不得少于1.0%（ml/g）。牛蒡子（C错）含苷类成分，如牛蒡子苷元和牛蒡子苷。斑蝥（D错）中主要含单萜类成分：斑蝥素。斑蝥素是其有效成分，也是毒性成分。《中国药典》规定，斑蝥含斑蝥素不得少于0.35%。黄连（E错）的有效成分主要是生物碱，已经分离出来的生物碱有小檗碱（含量最高）、巴马汀、黄连碱、甲基黄连碱、药根碱和木兰碱（属于阿朴啡型）等；大多属苄基异喹啉类衍生物，季铵型生物碱。《中国药典》以盐酸小檗碱为指标成分进行含量测定。要求味连含小檗碱不得少于5.5%，表小檗碱不得少于0.80%，黄连碱不得少于1.6%，巴马汀不得少于1.5%；要求雅连含小檗碱不得少于4.5%；要求含小檗碱不得少于7.0%。